较早对儿科发疹性传染病加以鉴别的医家是
A. 扁鹊
B. 淳于意
C. 钱乙
D. 万全
E. 谢玉琼

正确答案：C。钱乙

解析：钱乙对中医儿科学体系的形成作出了突出贡献，因而被誉为“儿科之圣”，其较早对儿科发疹性传染病加以鉴别（C对）。《史记.扁鹊仓公列传》记载扁鹊入咸阳，闻秦人爱小儿，即为小儿医（A错）。西汉名医淳于意（仓公）曾以下气汤治疗小儿气鬲病，并记录了儿科最早的医案（B错）。明代儿科世医万全，著作颇丰，他的处方用药精练而切合病情，并将推拿疗法用于儿科，其学术观点和临床经验丰富了中医儿科学的学术内容（D错）。谢玉琼的《麻科活人全书》是一部麻疹专著，详细阐述了麻疹各期及合并症的辨证和治疗（E错）。